患儿，腹泻3天，口唇黏膜干燥，精神萎靡，皮肤干燥、弹力差；眼窝、前囟明显凹陷；哭时少泪。脱水程度为
A. 轻度
B. 中度
C. 重度
D. 极重度
E. 无脱水

正确答案：B。中度

解析：脱水是指水分摄入不足或丢失过多所引起的体液总量尤其是细胞外液量的减少，脱水时除丧失水分外，尚有钠、钾和其它电解质的丢失，常分为轻、中、重三度（DE错）。其中，轻度（A错）脱水为失水量占体重5%以下（30～50mL/kg），患儿多精神正常或稍差；皮肤稍干燥，弹性尚可；眼窝、前囟轻度凹陷；哭时有泪；口唇黏膜稍干；尿量稍减少。中度脱水为失水量占体重的5～10%（50～100mL/kg），多致患儿精神萎靡或烦躁不安，皮肤干燥、弹力差；眼窝、前囟明显凹陷；哭时少泪；口唇黏膜干燥；四肢稍凉，尿量明显减少，本病例临床表现与之相符（B对）。重度（C错）脱水为失水量占体重的10%以上（100～120mL/kg），患儿多呈重病容，精神极度萎靡，表情淡漠，昏睡甚至昏迷；皮肤灰白或有花纹，干燥，失去弹性；眼窝、前囟深度凹陷，闭目露睛；哭时无泪；舌无津，口唇黏膜极干燥；因血容量明显减少可出现休克症状，如心音低钝，脉细而快，血压下降，四肢厥冷，尿极少或无尿等。